经产妇，26岁。妊娠37周，晨起发现阴道流血，无明显腹痛，检查有宫缩，查体子宫大小大于孕周数，胎心存在。最可能诊断
A. 前置胎盘
B. 先兆流产
C. 胎盘早剥
D. 难免流产
E. 胎膜早破

正确答案：A。前置胎盘

解析：青年经产妇，妊娠37周（妊娠28周及以后称为妊娠晚期），晨起发现阴道流血，无明显腹痛（前置胎盘的典型症状为妊娠晚期或临产时，发生无诱因、无痛性反复阴道流血）（A对）。胎盘早剥（P130）（C错）典型症状为妊娠中期突发持续性腹痛，伴或不伴阴道流血。先兆流产（P48）（B错）指妊娠28周前先出现少量阴道流血，常为暗红色或血性白带，无妊娠物排出，随后出现阵发性下腹痛或腰背痛，妇科检查宫颈口未开，胎膜未破，子宫大小与停经周数相符（该病例出现子宫大小大于孕周数）。难免流产（P48）（D错）是指在先兆流产基础上，阴道流血量增多，阵发性下腹痛加剧，或出现阴道流液，妇科检查宫颈口已扩张，有时可见胚胎组织或胎囊堵塞于宫颈口内，子宫大小与停经周数基本相符或略小。胎膜早破（P133）（E错）的患者突感有较多液体从阴道流出，有时可混有胎脂及胎粪，无腹痛等其他产兆。